关于肠系膜上动脉的描述，正确的是
A. 平第2腰椎高度起于腹主动脉
B. 越过十二指肠上部前方
C. 沿胰体后方下行
D. 经十二指肠水平部后方进入小肠系膜根
E. 走在肠系膜两层之间

正确答案：C。沿胰体后方下行

解析：肠系膜上动脉约平第1腰椎（A错）的高度起自腹主动脉的前壁。经胰头和胰体交界处的后方下行（C对）。越过十二指肠水平部的前面（D错）进入肠系膜根。